慢性肾功能衰竭患者可产生
A. 低钙血症
B. 低磷血症
C. 两者均有
D. 两者均无
E. 无

正确答案：A。低钙血症

解析：慢性肾功能衰竭时肾排磷减少，血磷升高（B错）导致血钙降低（A对）。VitD在肾最终羟化形成1，25-（0H）2D3而起生理作用，慢性肾功能衰竭引起VitD羟化障碍而产生低血钙。慢性肾衰时，骨骼对PTH敏感性降低，成骨和溶骨作用减少，血钙降低。肾毒物损伤肠道可使肠道吸收功能受损，钙吸收障碍。